伦理学作为学科出现的标志是
A. 《黄帝内经》
B. 宋国宾《医业伦理学》
C. 孙思邈《备急千金要方》
D. 《希波克拉底誓言》
E. 帕茨瓦尔《医学伦理学》

正确答案：E。帕茨瓦尔《医学伦理学》

解析：医学伦理学在近代的西方已形成一门独立的学科，它首先产生于英国。它的形成以l803年英国的托马斯·帕茨瓦尔的《医学伦理学》出版为标志（E对）。希波克拉底被称为西方医德的奠基人。进入20世纪中叶，近现代医学伦理学无论是在规范体系还是理论基础方面都较完善了，其标志是l948年《日内瓦宣言》和1949年《国际医德守则》的颁布。